从牙尖交错位下颌可以向后移动约1mm，下颌的这个位置称
A. 牙位
B. 下颌姿势位
C. 牙尖交错位
D. 正中（牙合）位
E. 后退接触位

正确答案：E。后退接触位

解析：后退接触位：从牙尖交错位下颌可以向后移动约1mm，此时，前牙不接触，只有后牙牙尖斜面部分接触，髁突位于关节窝中的功能最后位置，从此位置开始下颌可以做侧向运动，下颌的这个位置称为后退接触位，是下颌的生理性最后位。掌握“牙尖交错位、后退接触位与正中关系”知识点。